女，70岁。外阴、阴道灼热感4天。妇科检查：阴道粘膜有散在出血点，阴道内少许分泌物，呈淡黄色，该患者首选的外用药物是
A. 制霉菌素
B. 红霉素
C. 孕激素
D. 雌激素
E. 甲硝唑

正确答案：D。雌激素

解析：该患者为老年女性（萎缩性阴道炎常见于自然绝经或人工绝经后妇女），外阴、阴道灼热感4天（主要症状为外阴灼热不适），阴道黏膜有散在出血点，分泌物少许，呈淡黄色（阴道分泌物稀薄，呈淡黄色，妇检可见阴道黏膜充血，有散在小出血点或点状出血斑），故首先考虑为萎缩性阴道炎。绝经后妇女因雌激素水平降低，阴道壁萎缩，黏膜变薄，上皮细胞内糖原减少，阴道pH增高，乳杆菌不再是优势菌，局部抵抗力降低，引起炎症。针对病因，该患者首选的外用药物是雌激素（D对）。制霉菌素（P250）（A错）主要用于治疗外阴阴道念珠菌病。红霉素（P102）（B错）主要用于治疗支原体、衣原体感染。甲硝唑（P248、P250）（E错）主要用于治疗滴虫阴道炎和细菌性阴道病。